某男，59岁。腰部冷痛，酸软无力，卧则减轻，得热则舒，肢冷畏寒，面色㿠白；舌淡，脉沉细无力。宜选用的基础方剂是
A. 右归丸
B. 理中汤
C. 左归丸
D. 四妙丸
E. 四物汤

正确答案：A。右归丸

解析：本题考查的是腰痛的辨证论治。腰部冷痛，酸软无力，卧则减轻，得热则舒，肢冷畏寒，面色㿠白；舌淡，脉沉细无力。宜选用的基础方剂是右归丸（A对）。腰痛，又称“腰脊痛”，是指因外感、内伤或挫闪等导致腰部气血运行不畅，或失于濡养，引起的以腰部一侧或两侧疼痛为主要症状的疾病。西医学的腰肌纤维炎、强直性脊柱炎、腰椎骨质增生、腰椎间盘病变、腰肌劳损等腰部病变以及某些内脏疾病，以腰痛为主要症状者，可参考本篇辨证论治。（一）肾虚腰痛：【症状】腰部隐隐作痛，酸软无力，劳则加重，卧则减轻，或伴有耳鸣耳聋。偏于肾阴虚者，兼有手足心热，潮热盗汗，口燥咽干，舌红少苔，脉细数；偏于肾阳虚者，兼有腰部冷痛，得热则舒，肢冷畏寒，面色㿠白，舌淡胖有齿痕，脉沉细无力。【方剂应用】基础方剂为：偏于肾阴虚者，以左归丸（C错）（熟地黄、山药、枸杞子、山茱萸、川牛膝、菟丝子、鹿角胶、龟板胶）加减。偏于肾阳虚者，以右归丸（熟地黄、山药、山茱萸、枸杞子、菟丝子、鹿角胶、杜仲、肉桂、当归、制附子）加减。（二）瘀血腰痛：【症状】腰痛如刺，痛有定处，痛处拒按，日轻夜重，轻者俯仰不便，重则不能转侧。舌质暗紫，或有瘀斑，脉涩。【方剂应用】基础方剂为身痛逐瘀汤（秦艽、川芎、桃仁、红花、甘草、羌活、没药、当归、五灵脂、香附、牛膝、地龙）加减。（三）湿热腰痛：【症状】腰部疼痛，重着而热，暑湿阴雨天气症状加重，活动后或可减轻，身体困重，小便短赤。舌质红，苔黄腻，脉濡数或弦数。【方剂应用】基础方剂为四妙丸（D错）（黄柏、苍术、牛膝、薏苡仁）加减。（四）寒湿腰痛：【症状】腰部冷痛重着，转侧不利，逐渐加重，静卧疼痛不减，寒冷和阴雨天加重。舌质淡，苔白腻，脉沉而迟缓。【方剂应用】基础方剂为甘姜苓术汤（甘草、干姜、茯苓、白术）加减。四物汤（E错）为虚劳血虚证的方剂应用。虚劳血虚证：【症状】头晕眼花，心悸多梦，手足发麻，面色淡黄或淡白无华，口唇、爪甲色淡，妇女月经量少。舌质淡，脉细。【方剂应用】基础方剂为四物汤（熟地黄、当归、川芎、芍药）加减。方剂应用为理中汤（B错）的病证，2022年考试指南未明确说明。